患者清晨腹痛，痛即作泻，形寒肢冷，精神萎靡，面色㿠白，脉迟无力。其证候是
A. 脾气虚
B. 脾阳虚
C. 寒湿困脾
D. 食滞胃脘
E. 命门火衰

正确答案：E。命门火衰

解析：命门火衰中医病证名又称肾阳衰微、肾阳虚衰。清晨腹痛，痛即作泻，是属于肾虚泻。肾阳不足，火不暖土，脾失健运，故清晨腹痛，痛即作泻；肾阳虚衰，温煦失职，故形寒肢冷；阳虚温煦功能减弱，不能振奋精神，故精神萎靡；阳虚不能温运气血上荣于面，面部血络失充，故面色㿠白；脉迟无力，为肾阳不足之症，故其证候为肾阳不足证，即命门火衰证（E对）。脾气虚（A错）证证候表现为不欲食或纳少，腹胀，食后胀甚，便溏，神疲乏力，少气懒言，肢体倦怠，舌淡苔白，脉缓或弱。脾阳虚（B错）证证候表现为腹痛绵绵，喜温喜按，纳少，腹胀，大便清稀或完谷不化，畏寒肢冷，舌苔白滑，脉沉迟无力。寒湿困脾证（C错）证候表现为脘腹痞闷，腹痛便溏，口腻纳呆，泛恶欲呕，头身困重，面色晦黄，舌淡胖，苔白腻，脉濡缓或沉细。食滞胃脘（D错）证证候表现为胃脘胀满疼痛，拒按，厌恶食物，嗳腐吞酸，大便酸腐臭秽，舌苔厚腻，脉滑。